沉香中具有镇静作用的成分类别是
A. 生物碱类
B. 挥发油类
C. 香豆素类
D. 皂苷类
E. 内酯类

正确答案：B。挥发油类

解析：本题考查沉香的化学成分。沉香中具有镇静作用的成分类别是挥发油类（B对）。沉香【成分】含挥发油及树脂。挥发油中含沉香螺萜醇、白木香酸及白木香醛，具有镇静作用。苍术醇是沉香螺萜醇的差向异构体，具有抗胃溃疡的作用。钩藤【成分】茎和根含钩藤碱、异钩藤碱（此二者为降血压的有效成分）、去氢钩藤碱、去氢异钩藤碱、柯南因。钩藤碱、异钩藤碱为生物碱（A错）。柴胡【成分】柴胡除含挥发油、皂苷外，尚含多元醇、植物甾醇、香豆素（C错）、脂肪酸等成分。地上部分含有黄酮。人参含有皂苷（D错）、多糖和挥发油等多种化学成分，人参皂苷为人参的主要有效成分之一。人参皂苷、人参多糖是人参提高免疫功能的有效成分。秦皮的原植物主要有两种，即木犀科植物大叶白蜡树及白蜡树，大叶白蜡树皮中主要含七叶内酯（E错）（秦皮乙素）和七叶苷（秦皮甲素），而白蜡树皮中主要含白蜡素和七叶内酯以及白蜡树苷。